牙周膜中最多，在功能上最主要的细胞为
A. 成纤维细胞
B. 牙周膜干细胞
C. 成牙骨质细胞
D. Malassez上皮剩余
E. 成骨细胞

正确答案：A。成纤维细胞

解析：成纤维细胞：在牙周膜中最多，在功能上也是最主要的细胞。掌握“牙周膜”知识点。